甘油属于
A. 极性溶剂
B. 非极性溶剂
C. 半极性溶剂
D. 着色剂
E. 防腐剂

正确答案：A。极性溶剂

解析：本题考查液体制剂的溶剂。甘油属于极性溶剂（A对BC错）；着色剂（D错）是为食品着色的物质,按来源分为化学合成色素和天然色素两类；防腐剂（E错）是能抑制微生物活动,防止食品腐败变质的一类食品添加剂。